通常人的唾液中除含有唾液淀粉酶外，还含有
A. 凝乳酶
B. 麦芽糖酶
C. 溶菌酶
D. 肽酶
E. 蛋白水解酶

正确答案：C。溶菌酶

解析：溶菌酶（C对）广泛存在于唾液、眼泪、血浆、尿、乳汁等多种液体中，具有杀灭细菌和病毒作用，是机体固有免疫的重要组成部分。凝乳酶（A错）主要存在于胃液中（酸性蛋白酶，被胃酸激活），可使乳汁内的蛋白质凝聚成乳酪后易为各种蛋白酶所消化。麦芽糖酶（B错）主要存在于小肠中分解麦芽糖。肽酶（D错）是一种能水解肽链的酶，消化道中的肽酶有三种：一种是羧基肽酶，来源于胰腺和小肠腺：另两种分别是氨基肽酶和二肽酶，均来源于小肠腺。蛋白水解酶（E错）包括胃蛋白酶、胰蛋白酶等，存在于胃和小肠等部位。